由小痣细胞组成，位于真皮内的是
A. 交界瘤
B. 皮内痣
C. 复合痣
D. 毛痣
E. 雀斑样痣

正确答案：B。皮内痣

解析：本题考查色素痣。皮内痣（B对）由小痣细胞组成，位于真皮内。交界痣（A错）由大痣细胞组成，痣细胞在表皮和真皮交界处，呈多个巢团状。在痣细胞进入真皮过程中，同时有皮内痣和残留的交界痣，称为复合痣（C错）。毛痣（D错）和雀斑样痣（E错）均为皮内痣或复合痣。